从相似的事物中寻找不同的特点
A. 求同法
B. 求异法
C. 共变法
D. 排除法
E. 类比法

正确答案：B。求异法